砷代谢及毒作用机制的描述，不正确的是
A. 五价砷能阻断线粒体中氧化磷酸化，从而抑制ATP的合成
B. 在消化道内，五价砷比三价砷易吸收
C. 三价砷使机体抗氧化系统平衡失调，引起脂质过氧化损伤
D. 三价砷和酶的结合不稳定，能自行水解，使酶的活性恢复
E. 五价砷主要以砷酸盐形式蓄积于骨组织中

正确答案：D。三价砷和酶的结合不稳定，能自行水解，使酶的活性恢复

解析：本题考查砷代谢及毒作用机制。在消化道内，五价砷比三价砷易吸收（B对），三价砷可使机体抗氧化系统平衡失调，引起脂质过氧化损伤（C对）。五价砷主要以砷酸盐形式蓄积于骨组织中（E对），五价砷能阻断线粒体中氧化磷酸化，从而抑制ATP的合成（A对）。但五价砷和酶的结合物不稳定，能自行水解，使酶的活性恢复（D错，为本题正确答案）。